下列关于药物相互作用的叙述，错误的是
A. 药物相互作用概念有广义与狭义之分
B. 狭义的药物相互作用指两种或两种以上药物在体内药动学和药效学的改变
C. 广义的药物相互作用指两种或两种以上药物在体外的物理或化学变化和体内药理改变
D. 药物与临床检验试剂的相互作用不属药物相互作用
E. 药物相互作用是任何新药说明书上必列项目

正确答案：D。药物与临床检验试剂的相互作用不属药物相互作用